治疗绝经后晚期乳腺癌的药物是
A. 氨鲁米特
B. 顺铂
C. 羟喜树碱
D. 他莫昔芬
E. 阿糖胞苷

正确答案：D。他莫昔芬

解析：本题考查他莫昔芬。他莫昔芬（D对）用于治疗晚期乳腺癌和卵巢癌。安鲁米特（A错）用于晚期前列腺癌。顺铂（B错）用于卵巢癌、前列腺癌、睾丸癌、肺癌、鼻咽癌、食道癌、恶性淋巴瘤、头颈部鳞癌、甲状腺癌及成骨肉瘤等多种实体肿瘤。羟喜树碱（C错）用于原发性肝癌、胃癌、膀胱癌、直肠癌、上皮癌及白血病。阿糖胞苷（E错）用于治疗急性白血病。